对某无工业污染山村的儿童生长智力发育和疾病发病状况的调查发现，该地区部分儿童身体发育迟缓和智力低下，除外未发现其他异常。当地儿童所患的疾病最可能是
A. 硒缺乏病
B. 砷中毒
C. 铅中毒
D. 碘缺乏病
E. 氟中毒

正确答案：D。碘缺乏病

解析：甲状腺激素在儿童生长及神经发育中起重要作用，碘是甲状腺合成的必需原料。患儿身体发育迟缓，智力低下是缺碘的典型表现（D对）。